女，28岁。突发剧烈头痛、呕吐5小时。查体：神志清楚，躁动，颈项强直，深反射亢进，克氏征阳性。头颅CT示侧裂池、环池内高密度影。首先考虑的诊断是
A. 硬脑膜下血肿
B. 脑积水
C. 蛛网膜下腔出血
D. 脑膜炎
E. 脑炎

正确答案：C。蛛网膜下腔出血

解析：青年女性患者，突发剧烈头痛、呕吐（颅内压增高表现）5小时。查体：神志清楚，躁动，颈项强直，深反射亢进（脑膜刺激征阳性），克氏征阳性（提示椎体束病变）。头颅CT示侧裂池、环池内高密度影（脑出血影像表现）。根据患者病史、临床表现、查体及影像学检查，该患者最可能的诊断为蛛网膜下腔出血（C对）。硬膜下血肿（A错）（P205）多表现为伤后持续昏迷或昏迷进行性加重，CT扫描的典型表现为脑表面新月形高密度影。脑积水（B错）常表现为头痛、呕吐、视力模糊，眩晕及癫痫发作等，CT可见颅腔扩大，颅骨变薄。脑膜炎（D错）系指软脑膜的弥漫性炎症性改变，以发热、头痛、呕吐、烦躁等症状为主要表现。脑炎（E错）患者多有高热和全身不适等病毒血症的表现，与患者表现不符。